体现入血就恐耗血动血，直须凉血散血的药对是
A. 犀角、竹叶
B. 银花、连翘
C. 犀角、生地
D. 丹皮、赤芍
E. 丹皮、生地

正确答案：D。丹皮、赤芍

解析：入血就恐耗血动血，直须凉血散血的意思是邪热进入血分，可耗伤营血，甚至迫血妄行，故当治以凉血散血之品，清血分热毒，控制血热妄行，并防热毒瘀结。芍药、丹皮，清热凉血，活血散瘀，可收化斑之功（D对）。犀角、竹叶只有凉血之功，无散血之功（A错）。银花、连翘长于清气分邪热（B错）。犀角清热凉血，生地凉血滋阴（C错）。丹皮清热凉血，活血散瘀；生地凉血滋阴（E错）。